腭前孔注射法又称
A. 上牙槽后神经阻滞麻醉
B. 眶下神经阻滞麻醉
C. 腭前神经阻滞麻醉
D. 鼻腭神经阻滞麻醉
E. 下牙槽神经阻滞麻醉

正确答案：D。鼻腭神经阻滞麻醉

解析：鼻腭神经阻滞麻醉：将麻药注入腭前孔（切牙孔），以麻醉鼻腭神经，故又称为腭前孔注射法。掌握“颌面部常用局麻法及牙拔除的麻醉选择”知识点。